翻瓣术手术纵形切口应位于
A. 龈乳头中央
B. 颊面中央
C. 舌腭侧中央
D. 颊面轴角处
E. 以上均可

正确答案：D。颊面轴角处

解析：纵行切口也称垂直切口，是为了减小组织张力、更好地暴露术区。纵切口的位置应在术区近、远中侧比较健康的牙龈组织上，位于牙的颊面轴角处，一般将龈乳头包括在龈瓣内，以利于术后缝合。切忌在龈乳头中央、或颊面中央处作纵切口，以防止影响愈合，也尽量避免在舌腭侧作纵切口，因可能会伤及血管、神经，出血多、或影响愈合。掌握“慢性牙周炎的治疗原则、程序及方法”知识点。